出生队列分析在死亡统计中，可正确地显示
A. 暴露对疾病的影响
B. 环境对疾病的影响
C. 致病因子与年龄的关系
D. 家庭对疾病的影响
E. 种族对疾病的影响

正确答案：C。致病因子与年龄的关系

解析：本题考查出生队列分析的用途。出生队列分析是指利用出生队列资料将疾病年龄分布和时间分布结合起来的描述方法。它可以明确地呈现致病因子与年龄（C对ABDE错）的关系，有助于探明年龄、所处时代暴露特点及经历在疾病的频率变化中的作用。